左心衰的主要表现是
A. 体循环淤血
B. 双肺哮鸣音
C. 双肺湿啰音
D. 肺纹理增粗
E. 肺循环淤血

正确答案：E。肺循环淤血

解析：左心衰竭以肺淤血及心排血量降低表现为主（E对）。右心衰竭以体循环淤血的表现为主（A错）。双肺哮鸣音为哮喘患者最具有特征的体征（B错）。双肺湿啰音、肺纹理增粗为肺系疾病的非特异性体征（CD错）。